静息电位产生的离子基础是
A. K⁺
B. Na⁺
C. Ca²⁺
D. Cl⁻
E. H⁺

正确答案：A。K⁺

解析：细胞在静息时，对K⁺通透性最大，K⁺受浓度差驱动，由细胞内向细胞外流动，形成静息电位（A对）。安静时，细胞膜对于Na⁺（B错）的通透性约为K⁺的1/500～1/50，其对于静息电位的影响远小于K⁺；Ca²⁺（C错）、Cl⁻（D错）、H⁺（E错）均对静息电位的形成无明显作用。